下列原料药中易风化的药品有
A. 硫酸阿托品
B. 胃蛋白酶
C. 硫酸镁
D. 硫酸钠
E. 氯化钠

正确答案：A、C、D。硫酸阿托品；硫酸镁；硫酸钠

解析：本题考查药品的贮存。原料药硫酸阿托品（A对）、硫酸镁（C对）和硫酸钠（D对）结构中含结晶水，暴露在干燥空气中会风化。胃蛋白酶（B错）原料药易受温度影响。氯化钠（E错）原料药不含结晶水不会发生风化。